固位体的（牙合）力主要通过哪个部分传递到颌骨上
A. 桥体
B. 连接体
C. 固位体
D. 基牙
E. 黏膜

正确答案：D。基牙

解析：固位体是粘结在基牙上的，固位体承受咬合力，在受力的过程中，将力传导给基牙，从而传导到颌骨上。掌握“固定桥的设计”知识点。